肿瘤内含有筛孔状囊样腔隙，与藕的断面相似；孔内充满嗜酸或嗜碱性黏液样物质，有基底膜样结构，属于腺样囊性癌的哪种分型
A. 腺性型
B. 包膜型
C. 管状型
D. 黏液型
E. 实性型

正确答案：A。腺性型

解析：本题考查腺样囊性癌的组织类型。肿瘤内含有筛孔状囊样腔隙，与藕的断面相似；孔内充满嗜酸或嗜碱性黏液样物质，有基底膜样结构，属于腺样囊性癌的腺性型（A对）。腺性（筛状）型腺样囊性癌主要特点是：肿瘤细胞团块内含有筛孔状囊样腔隙，与藕的断面相似；筛孔内充满嗜酸或嗜碱性黏液样物质，腔隙周围有基底膜样结构。